鼻咽癌和舌根癌时，癌细胞经淋巴管首先转移到
A. 颈内静脉二腹肌淋巴结
B. 颈外侧浅淋巴结
C. 副神经淋巴结
D. 锁骨上淋巴结
E. 斜角肌淋巴结

正确答案：A。颈内静脉二腹肌淋巴结

解析：鼻咽癌和舌根癌时，癌细胞首先转移至颈内静脉二腹肌淋巴结（A对）。